茯苓与薏苡仁均有的功效是
A. 利水渗湿，安神
B. 利水渗湿，除痹
C. 利水渗湿，通乳
D. 利水渗湿，解毒
E. 利水渗湿，健脾

正确答案：E。利水渗湿，健脾